表现为排尿突然中断的疾病是
A. 尿道结石
B. 肾结石
C. 膀胱结石
D. 前列腺增生
E. 肾癌

正确答案：C。膀胱结石

解析：排尿突然中断是膀胱结石（C对）的典型表现。尿道结石（A错）的典型症状为排尿困难，点滴状排尿，伴尿痛。肾结石（B错）主要表现为肾区疼痛伴肋脊角叩击痛，常见镜下血尿。前列腺增生（D错）典型表现为尿频、进行性排尿困难。肾癌（E错）主要表现为间歇无痛肉眼血尿、腰痛和腹部肿块。